不寐的病位主要在
A. 心
B. 脑
C. 肝
D. 脾
E. 肾

正确答案：A。心

解析：心主神明，神安则寐，神不安则不寐，不寐多因各种原因导致的心脏功能失常。脏腑调和，气血充足，心神安定，心血得静，卫阳得以入阴，则睡卧有时。故不寐主要病位在心（A对）。不寐是阳盛阴衰，阴阳失交所致，与脑无关（B错）。肝郁化火，上扰心神可致不寐；脾虚则血液生化不足，不能上奉于心，使心失所养而致不寐；肾阴亏虚，肾水不能上济于心，致心肾不交而致不寐，均为影响心而致不寐（CDE错）。